女，35岁，因反复上腹疼痛，做胃镜检查诊断为十二指肠球溃疡，HP（+）。应选择下列哪组药物治疗最合适
A. 奥美拉唑+CBS+抗生素
B. 奥美拉唑+阿托品
C. 硫糖铝+阿托品+抗生素
D. 前列腺素+硫糖铝
E. 法莫替丁+抗生素

正确答案：A。奥美拉唑+CBS+抗生素

解析：中年女性患者，反复上腹疼痛，做胃镜检查诊断为十二指肠球溃疡，HP（+），考虑诊断为十二指肠溃疡。HP（+）提示患者伴有幽门螺杆菌感染。最有效的治疗方案是根除幽门螺杆菌治疗，如三联疗法（1种质子泵抑制剂+2种抗生素或1种铋剂+2种抗生素）或四联疗法（1种质子泵抑制剂+1种铋剂+2种抗生素），疗程7～14天。该题目选项中，奥美拉唑为质子泵抑制剂，枸橼酸铋钾（CBS）为铋剂，阿托品为M受体阻断剂，法莫替丁为H₂受体阻滞剂，硫糖铝为弱碱性抗酸剂，故奥美拉唑+阿莫西林+替硝唑为最有效的治疗方案（A对）。H₂受体阻滞剂抑酸率和溃疡愈合率低于质子泵抑制剂，故不用H₂受体拮抗剂替代质子泵抑制剂（E错）。根除幽门螺杆菌治疗方案中至少含两种抗生素（BCDE错）。